在常规计量下，5α还原酶抑制剂可使（血清前列腺特异抗原）PSA水平下降幅度是
A. 0.1
B. 0.2
C. 0.3
D. 0.4
E. 0.5

正确答案：E。0.5

解析：本题考查5α还原酶抑制剂。在常规计量下，5α还原酶抑制剂可使（血清前列腺特异抗原）PSA水平下降幅度是0.5（E对）。常用剂量下，5α还原酶抑制剂可使血清前列腺特异抗原（PSA）水平下降50%。